女，22岁，医学生。最近与男友发生激烈争执，以致两人分手，情绪极度低落，也十分愤恨，来找学校心理咨询师求帮助。心理咨询师针对其情绪的调节提出的办法不适合的是
A. 不断宣泄
B. 降低期望
C. 心理应对
D. 改变认知
E. 放松训练

正确答案：A。不断宣泄

解析：来访者为青年女性，因失恋所致情绪极度低落及愤恨，从认知疗法中理性情绪疗法的ABCDEF模式可知，B（信念）是决定个体对A（事件）所诱发的C（行为或情绪）的真正原因，因此改变认知（D对）、降低期望（B对）、心理应对（C对）可促成来访者建立新的情绪调节机制，是一种合适方法，从行为疗法的角度来看待此问题，放松训练（E对）的练习可缓解并逐渐打破来访者接受不良刺激引起焦虑、愤怒等不良情绪的反射弧，同样可促成来访者建立新的情绪调节机制，亦为一种较合适的方法，宣泄虽可以短暂释放来访者所承受的一定压力，但其始终无法建立起更有利于来访者的情绪调节机制，且宣泄被用于多种心理治疗中时均为适度宣泄，并非如选项所指不断宣泄（A错，为本题正确选项）。